石膏性大寒，味甘辛，能清热泻火，生津止渴，生肌敛疮，主含
A. 硫酸铜
B. 碳酸钙
C. 含水硅酸镁
D. 含水硅酸铝
E. 含水硫酸钙

正确答案：E。含水硫酸钙

解析：本题考查的是石膏的来源。石石膏性大寒，味甘辛，能清热泻火，生津止渴，生肌敛疮，主含含水硫酸钙（E对）。石膏：【来源】为硫酸盐类矿物硬石膏族石膏。主含含水硫酸钙（CaSO₄·2H₂O）。主含碳酸钙（B错）的中药为牡蛎。牡蛎：【来源】为软体动物门牡蛎科动物长牡蛎、大连湾牡蛎或近江牡蛎的贝壳。牡蛎主要含碳酸钙。主含水硅酸镁（C错）的中药为滑石。滑石：【来源】为硅酸盐类矿物滑石族滑石。主要含含水硅酸镁[Mg₃（Si₄O₁₀）（OH）₂]。主含硫酸铜（A错）或主含水硅酸铝（D错）的中药，2022年考试指南未明确说明。